某患者，突然出现高热，乏力，伴有腓肠肌疼痛，眼结膜出血以及淋巴结肿大。印象诊断是钩体病。该病原体的主要传染源和储存宿主是
A. 鼠和犬
B. 猪和犬
C. 鼠和猪
D. 牛和马
E. 羊和牛

正确答案：C。鼠和猪

解析：钩端螺旋体所致的钩体病为典型的人兽共患病。鼠类和猪、牛为主要传染源和储存宿主，其带菌率很高，且排菌期长。掌握“概述及梅毒螺旋体”知识点。